不属于手少阴心经的腧穴是
A. 少冲
B. 少泽
C. 神门
D. 少海
E. 通里

正确答案：B。少泽

解析：少泽为手太阳小肠经腧穴第十版针灸学（B错，为本题正确答案）。少冲为手少阴心经井穴（A对）。神门为手少阴心经输穴、原穴（C对）。少海为手少阴心经合穴（D错）。通里为手少阴心经络穴（E错）。